某学生参加小学入学体检，远视力左眼0.5，右眼1.0。到眼科医院就诊，医生对他进行屈光矫正后，远视力为0.7。他患的是
A. 屈光性近视
B. 轴性近视
C. 弱视
D. 远视
E. 散光

正确答案：C。弱视